35岁前心脏性猝死的主要原因是
A. 心肌病
B. 心脏瓣膜病
C. 心包炎
D. 长QT综合征
E. 先天性心脏病

正确答案：A。心肌病

解析：绝大多数心脏性猝死发生在有器质性心脏病的患者。冠心病易患年龄前（35岁前），心脏性猝死的主要原因是心肌病（A对），如梗阻性肥厚型心肌病、致心律失常型右心室心肌病。此外还有离子通道病，如长QT综合征（D错）、Brugarda综合征，但不是最主要的原因。